孕妇慎用的中药是
A. 莪术
B. 半枝莲
C. 半边莲
D. 白茅根
E. 白附子

正确答案：E。白附子

解析：本题考查的是饮片的妊娠禁忌。孕妇慎用的中药是白附子（E对）。妊娠禁忌：指能影响胎儿生长发育，甚至造成堕胎的中药为妊娠禁忌用药。妇女在怀孕期间应避忌或慎用。妊娠禁忌药有毒性大小、性能峻缓之别，对胎儿及母体影响程度也有差别。据此，常分为禁用、忌用和慎用。禁用指绝对禁止使用，忌用指避免使用或最好不用，慎用指在一定条件下可谨慎使用，但必须有相应的措施，在没有特殊需要时应尽量避免使用，以免发生事故。现行版《中国药典》一部收录妊娠禁用、忌用和慎用药材和饮片共计99种。妊娠禁用药多为剧毒或性能峻猛的中药，妊娠慎用药一般包括活血祛瘀、破气行滞、攻下通便、辛热及滑利类的中药。具体品种为：①妊娠禁用药：丁公藤、三棱、干漆、土鳖虫、千金子、千金子霜、川乌、马钱子、马钱子粉、马兜铃、天仙子、天仙藤、巴豆、巴豆霜、水蛭、甘遂、朱砂、全蝎、红粉、芫花、两头尖、阿魏、京大戟、闹羊花、草乌、牵牛子、轻粉、洋金花、莪术（A错）、猪牙皂、商陆、斑蝥、雄黄、黑种草子、蜈蚣、罂粟壳、麝香。②妊娠忌用中药：大皂角、天山雪莲。③妊娠慎用药：人工牛黄、三七、大黄、川牛膝、制川乌、小驳骨、飞扬草、王不留行、天花粉、天南星、制天南星、天然冰片（右旋龙脑）、木鳖子、牛黄、牛膝、片姜黄、艾片（左旋龙脑）、白附子、玄明粉、西红花、肉桂、华山参、冰片（合成龙脑）、红花、芦荟、苏木、牡丹皮、体外培育牛黄、皂矾、没药、附子、苦楝皮、郁李仁、虎杖、金铁锁、乳香、卷柏、制草乌、草乌叶、枳壳、枳实、禹州漏芦、禹余粮、急性子、穿山甲、桂枝、桃仁、凌霄花、益母草、通草、黄蜀葵花、常山、硫黄、番泻叶、蒲黄、漏芦、赭石、薏苡仁、瞿麦、蟾酥。半枝莲（B错）、半边莲（C错）、白茅根（D错）均不属于妊娠禁忌用药。